男婴，4天。体温不升伴拒奶2天，足月儿，羊膜早破。查体：T35℃，皮肤巩膜黄染，面色发黄，肺（-）心（-），肝肋下3cm，脾肋下1cm。实验室检查：血型O型，血WBC16.0×10⁹/L，CRP20μmol/L，总胆红素205μmol/L。最可能的诊断是
A. 败血症
B. 肺炎
C. 溶血病
D. 低血糖
E. 颅内出血

正确答案：A。败血症

解析：男婴，4天，体温不升伴拒奶2天，足月儿，羊膜早破。查体：T35℃（新生儿正常腋下温度36～37℃），皮肤巩膜黄染，面色发黄（黄疸表现），肺（-）心（-），肝肋下3cm，脾肋下1cm（肝脾肿大），羊膜早破（考虑新生儿感染）。实验室检查：血型O型，血WBC16.0×10⁹/L（新生儿正常值15.0～20.0×10⁹/L），CRP20μmol/L（正常参考值≤10mg/L），提示细菌感染。综合患儿的病史、症状、实验室检查，考虑为新生儿败血症（A对）。新生儿肺炎（B错）常有肺部啰音体征，该患者双肺未闻及啰音，可排除。患婴出生4天，血清总胆红素＜221μmol/L，考虑生理性黄疸（C错）。新生儿低血糖（D错）（P134）大多无临床症状，排除新生儿低血糖。新生儿颅内出血（E错）常见颈项强直，排除新生儿颅内出血。